男性，68岁。反复咳嗽、咯痰20年，1周前感冒后病情加重，气促，发绀明显，颈静脉怒张，双下肢可凹陷性水肿。治疗关键为
A. 吸氧
B. 控制感染
C. 利尿强心
D. 通畅呼吸道
E. 呼吸兴奋剂

正确答案：B。控制感染

解析：患者反复咳嗽，咯痰20年，1周前感冒后病情加重，气促，发绀明显，颈静脉怒张，双下肢可凹陷性水肿，可诊断为慢性肺源性心脏病，由于感染引发急性加重，故治疗的关键为控制呼吸道感染，是提高疗效和降低病死率的重要措施（B对ACDE错）。